下列哪项不是妇幼保健服务利用的指标
A. 产前检查覆盖率
B. 住院率
C. 住院分娩率
D. 儿童有接种卡率

正确答案：B。住院率

解析：本题考查妇幼保健服务利用的指标。妇幼保健服务利用的指标有：妇科检查率、产前检查率（A对）、住院分娩率（C对）、儿童有接种卡率（D对）、住院分娩率、在家分娩率、产后访视率、低出生体重率等。住院率（B错，为本题正确答案）是住院服务利用的指标。